生命质量评价的内容是
A. 生理状态
B. 心理状态
C. 社会交往及主观满意度
D. 以上都包括

正确答案：D。以上都包括

解析：本题考查生命质量评价的内容。生命质量评价的内容通常包括生理状态、心理状态、社会功能状态、主观判断与满意度（D对ABC错），此外针对具体疾病的量表还包括疾病症状等内容。